支气管哮喘的临表现不包括
A. 发作性胸闷和咳嗽
B. 吸气性的呼吸困难
C. 夜间和清晨发作加剧
D. 给支气管舒张药可缓解
E. 干咳或咳白色泡沫痰

正确答案：B。吸气性的呼吸困难